患者因楔状缺损，复合树脂充填后，冷热刺激疼痛，不敢咬合。查：左上456颊面复合树脂充填，左上46冷测疼痛，去除后可缓解，左上5叩（+），冷热测疼痛明显，去除后持续一段时间。左上5的处理原则应为
A. 不治疗，观察
B. 脱敏治疗
C. 去除旧充填体，重新充填
D. 去除旧充填体，氧化锌丁香油糊剂安抚
E. 牙髓治疗

正确答案：E。牙髓治疗

解析：本题考查不可复性牙髓炎的治疗。患者因楔状缺损，复合树脂充填后，冷热刺激疼痛，不敢咬合。查：左上456颊面复合树脂充填，左上46冷测疼痛，去除后可缓解，左上5叩（+），冷热测疼痛明显，去除后持续一段时间。左上5的处理原则应为牙髓治疗（E对）。根据病例描述，左上4、5、6楔状缺损，复合树脂充填后，冷热刺激疼痛，不敢咬合，左上4、6冷测疼痛，去除后可缓解，左上5叩（+），冷热测疼痛明显，去除后持续一段时间，则考虑左上5为不可复性牙髓炎，应进行牙髓治疗；左上4、6为可复性牙髓炎，应去除旧充填体，氧化锌丁香油糊剂安抚（D错）。不治疗，观察（A错）适用于由物理刺激等引起的较轻的牙髓激惹症状，该病例中左上5已出现不可复性牙髓炎，应及时进行牙髓治疗，而不是观察。脱敏治疗（B错）适用于楔状缺损较浅、不便充填治疗且有牙本质敏感症状的情况，病例中楔状缺损已行充填治疗，且出现牙髓炎症症状，故不能使用脱敏治疗。左上5已有不可复性牙髓炎，应去除充填物，行牙髓治疗，而不是重新充填（C错）。